Fisher综合征的最主要临床特征是
A. 双侧对称性眼外肌和面肌麻痹
B. 由下肢逐渐向上肢进展的对称性迟缓性瘫痪
C. 眼外肌麻痹、共济失调、腱反射消失
D. 四肢弛缓性瘫痪伴眼外肌麻痹
E. 四肢对称性弛缓性瘫痪伴双侧面瘫

正确答案：C。眼外肌麻痹、共济失调、腱反射消失

解析：Fisher综合征是吉兰-巴雷综合征中的一个亚类。以眼肌麻痹、共济失调和腱反射消失为主要临床特点（C对），表现为四肢弛缓性瘫痪伴眼外肌麻痹。双侧对称性眼外肌和面肌麻痹（A错）为慢性进行性眼外肌麻痹的典型症状。由下肢逐渐向上肢进展的对称性迟缓性瘫痪（B错）、四肢对称性弛缓性瘫痪伴双侧面瘫（E错）为急性炎性脱髓鞘性多发神经根神经病的临床表现。急性炎性脱髓鞘性多发神经根神经病的严重患者会伴有肋间肌、膈肌及眼外肌麻痹（D错）。